不可内服的毒性中药是
A. 斑蝥
B. 轻粉
C. 生半夏
D. 红粉
E. 马钱子

正确答案：D。红粉

解析：本题考查红粉的用法。不可内服的毒性中药是红粉（D对）。红粉【内服特殊煎法和特殊用法】不可内服。【外用方法】外用适量，研极细粉单用或与其他药味配成散剂或制成药捻；不宜久用。斑蝥（A错）【用法用量】内服，0.03～0.06g，多炮制后入丸散用。外用适量，研末或浸酒醋，或制油膏涂敷患处。【注意事项】内服慎用，孕妇禁用，不宜大面积外用。轻粉（B错）【内服特殊煎法和特殊用法】内服每次0.1～0.2g，一日1～2次，多入丸剂或装胶囊服，服后漱口。【外用方法】外用适量，研末掺敷患处。生半夏（C错）【特殊调剂】用时捣碎。【内服特殊煎法和特殊用法】内服一般炮制后使用。【外用方法】外用适量，磨汁涂或研末以酒调敷患处。生马钱子（E错）【用法用量】内服，0.3～0.6g，炮制后入丸散。【注意事项】孕妇禁用；不宜生用；不宜多服久服；运动员慎用；有毒成分能经皮肤吸收，外用不宜大面积涂敷。